某男，57岁。患痢疾里急后重，医师处以枳实导滞丸。其功能除消积导滞外又能
A. 活血止痛
B. 疏肝解郁
C. 清利湿热
D. 健脾和胃
E. 化湿醒脾

正确答案：C。清利湿热

解析：本题考查枳实导滞丸的功能。其功能除消积导滞外又能清利湿热（C对）。枳实导滞丸【功能】消积导滞，清利湿热。六味安消散（胶囊）【功能】和胃健脾，消积导滞，活血止痛（A错）。解郁安神颗粒【功能】疏肝解郁（B错），安神定志。木香顺气丸（颗粒）【功能】行气化湿（E错），健脾和胃（D错）。